心衰时，心肌细胞内钙离子浓度降低的机制与下列哪一项因素无关
A. 细胞膜钙通道障碍
B. 肌质网摄取Ca2+增多
C. 肌质网释放Ca2+减少
D. 钙泵功能障碍
E. 酸中毒

正确答案：B。肌质网摄取Ca2+增多

解析：心衰时，心肌细胞去甲肾上腺素含量降低、β肾上腺素受体密度相对减少、对去甲肾上腺素的敏感性降低均导致β肾上腺素受体兴奋时，细胞膜钙通道障碍（A错），使胞外Ca2+内流减少。衰竭的心肌细胞中，肌质网钙释放蛋白的含量或活性降低，使肌质网释放Ca2+减少（C错）。同时还可存在钙泵功能障碍（D错），使肌质网摄取Ca2+减少（B对），胞质Ca2+浓度升高。酸中毒（E错）时，H+通过抑制Ca2+内流、升高肌质网中钙结合蛋白与Ca2+的亲和力，使胞质Ca2+浓度降低。